阳性结果可确定哺乳动物致癌物，阴性结果不能否定对哺乳动物致癌性，这类试验是
A. 构效关系分析
B. 致突变试验，恶性转化试验
C. 哺乳动物短期致癌试验
D. 哺乳动物长期致癌试验
E. 流行病学调查

正确答案：C。哺乳动物短期致癌试验